下列不属于病毒的减毒活疫苗的是
A. 乙型脑炎疫苗
B. 麻疹活疫苗
C. 甲型肝炎活疫苗
D. 风疹活疫苗
E. 流行性腮腺炎活疫苗

正确答案：A。乙型脑炎疫苗

解析：病毒的减毒活疫苗：主要有口服脊髓灰质炎减毒活疫苗（OPV或称Sabin活疫苗）、麻疹活疫苗、甲型肝炎活疫苗、风疹（冻干）活疫苗、流行性腮腺炎活疫苗、黄热病活疫苗等。掌握“病毒感染检查方法及防治原则”知识点。